口腔颌面外科常采用的闭式引流是
A. 片状引流
B. 纱条引流
C. 管状引流
D. 负压引流
E. 都不是

正确答案：D。负压引流

解析：本题考查外科引流。口腔颌面部的外科引流方式和分类方法较多，以常用的引流物可分为片状引流、纱条引流、管状引流和负压引流。其中口腔颌面外科常采用的闭式引流是负压引流（D对），而片状引流（A错）、纱条引流（B错）、管状引流（C错）的创口是开放的，称为开放引流。